晶状体曲折力正常而眼轴长度过长是
A. 真性近视
B. 假性近视
C. 斜视
D. 远视
E. 散光

正确答案：A。真性近视